引起梅毒的病原体是
A. 难辨梭菌
B. 苍白密螺旋体
C. 甲型溶血性链球菌
D. 人类乳头状瘤病毒
E. HIV

正确答案：B。苍白密螺旋体

解析：引起梅毒的病原体是苍白密螺旋体（B对）。难辨梭菌（艰难梭菌）（A错）是人类肠道中正常菌群之一，耐药的艰难梭菌可引起抗生素相关性腹泻和假膜性结肠炎（P137）。甲型溶血性链球菌（草绿色链球菌）（C错）属链球菌属，易引发龋齿和心内膜炎，是感染性心内膜炎最常见的致病菌（P102）。人类乳头瘤病毒（HPV）（D错）主要引起人类皮肤黏膜的增生性病变，其中高危性HPV（16型、18型等）与子宫颈癌等恶性肿瘤的发生密切相关，低危性HPV（6型、11型等）引起生殖器尖锐湿疣（P316）。HIV（人类免疫缺陷病毒）（E错）是获得性免疫缺陷综合征即艾滋病（AIDS）的病原体（P305）。